肾上腺素颜色变红的变化属于
A. 水解
B. 氧化
C. 异构化
D. 聚合
E. 脱羧

正确答案：B。氧化

解析：本题考查药物的降解途径。氧化（B对）是在氧的作用下物质发生的变化，是药物降解的主要途径之一。肾上腺素颜色变红是因为其分子中含有酚羟基，酚羟基被氧化所致。水解（A错）是药物降解的主要途径。属于这类降解的药物主要有酯类、酰胺类等。异构化（C错）是改变化合物的结构而不改变其组成和分子量的过程。聚合（D错）是两个或多个分子结合在一起形成复杂分子的过程。脱羧（E错）是在特殊情况下，羧酸脱去羧基的反应。